抗精神病药物应用原则不包括
A. 用药前进行常规的体检和辅助检查
B. 尽可能单一用药
C. 从小剂量开始，迅速加到治疗剂量
D. 剂量个体化
E. 足量、足疗程

正确答案：C。从小剂量开始，迅速加到治疗剂量

解析：抗精神病药物应用原则：①剂量的选择：用可以取得最大疗效的最小剂量，加减剂量一般宜逐渐进行（C错，为本题正确答案）；②尽量单一用药：两种以上抗精神病药物联用，不但不能提高疗效，反而引起多种不良反应（B对）；③剂量个体化：根据病人的症状、性别、年龄、体重、机体情况等个别化的原则，采用小剂量逐渐增药，直至出现最好疗效为止（D对）；④用药足量足疗程（E对）。